追风透骨丸【处方】制川乌100g，白芷100g，制草乌100g，香附（制）100g，甘草100g，白术（炒）50g，没药（制）20g，麻黄100g，川芎100g，乳香（制）50g，秦艽50g，地龙100g，当归50g，茯苓200g，赤小豆100g，羌活100g，天麻50g，赤芍100g，细辛100g，防风50g，天南星（制）100g，桂枝50g，甘松50g。【制法】以上二十三味粉碎成细粉，过筛，混匀100g粉末用炼蜜55～65g。加适量水制成水蜜丸。另将滑石粉、红氧化铁、胭脂红适量，混匀作包衣材料包衣，干燥即得。追风透骨丸的包衣种类是
A. 药物衣
B. 保护衣
C. 肠溶衣
D. 控释衣
E. 缓释衣

正确答案：A。药物衣

解析：本题考查的是丸剂包衣。追风透骨丸将滑石粉、红氧化铁、胭脂红适量，混匀作包衣材料包衣，其包衣种类是药物衣（A对）。丸剂包衣可提高药物稳定性，防止主药氧化、变质或挥发，防止吸潮及虫蛀；掩盖臭味、减少药物的刺激性；控制药物作用速度或部位，药物衣包于丸剂表面，可首先被吸收；包肠溶衣可在肠内溶散吸收；包缓释衣可制成长效制剂等；还有改善外观，便于识别等作用。不同类型的包衣应选用相宜的包衣材料。（1）药物衣：包衣材料是处方药物制成的极细粉，本身具有一定的药理作用，用于包衣既可首先发挥药效，又可保护丸粒、增加美观。常见的药物衣有朱砂衣（镇静、安神、补心类药物常用）、黄柏衣（利湿、渗水、清下焦湿热的药物常用）、雄黄衣（解毒、杀虫类药物常用）、青黛衣（清热解毒类药物常用）、百草霜衣（清热解毒类药物常用）等。（2）保护衣（B错）：选用性质稳定而无明显药理作用的材料将丸剂包衣，使主药与外界隔绝而起保护作用。常见的有薄膜衣、糖衣、有色糖衣、明胶衣等。（3）肠溶衣（C错）：选用肠溶材料（如聚丙烯酸树脂Ⅰ号、Ⅱ号、Ⅲ号，纤维醋法酯等）将丸剂包衣，使之在胃液中不溶散而能在肠液中溶散。控释衣（D错）与缓释衣（E错）为片剂的包衣类型。片剂包缓释或控释衣，改变药物释放速度，减少服药次数，降低不良反应。